下列哪项指标可对患某病的危险进行测量
A. 发病率乘以该病的平均病程
B. 发病率
C. 患病率
D. 发病率除以患病率
E. 患病率乘以该病的平均病程

正确答案：B。发病率

解析：本题考查发病率的应用。发病率（B对ACDE错）是疾病流行强度的指标，反映疾病对人群健康影响的程度，发病率高对人群健康危害大。通过发病率的比较，可了解疾病流行特征，探讨病因因素，提出病因假说，评价防制措施的效果。